铸造（牙合）支托在基牙（牙合）缘处的厚度为
A. 0.5～1.0mm
B. 1.0～1.5mm
C. 1.5～2.0mm
D. 2.0～2.5mm
E. 2.5～3.0mm

正确答案：B。1.0～1.5mm

解析：铸造（牙合）支托应薄而宽，呈匙形，颊舌宽度约为磨牙颊舌径的1/3或前磨牙的颊舌径的1/2。其长度约为磨牙近远中径的1/4或前磨牙近远中径的1/3，厚度为1～1.5mm。掌握“局部义齿人工牙及基托”知识点。